男，45岁。体检发现空腹血糖8mmol/L，餐后2h血糖13mmol/L，血清甘油三酯3.5mmol/L，低密度酯蛋白胆固醇3.6mmol/L。无明显不适，半年内体重下降10kg。查体：BP160/100mmHg，BMI28，心肺查体无阳性发现。首选的降血糖药物是
A. 阿卡波糖
B. 瑞格列奈
C. 罗格列酮
D. 二甲双胍
E. 格列本脲

正确答案：D。二甲双胍

解析：中年男性患者，体型肥胖（BMI＜18.5为偏瘦，18.5～23.9为正常体型，24.0～27.9为超重，≥28为肥胖）（2型糖尿病好发人群），半年内体重下降10kg，空腹血糖8mmol/L，餐后2h血糖13mmol/L，考虑诊断为2型糖尿病。患者应在进行生活方式干预的同时给予口服药物治疗，二甲双胍主要通过抑制肝葡萄糖输出，改善外周组织对胰岛素的敏感性，增加对葡萄糖的摄取和利用而降低血糖，可减轻体重，改善血脂谱。主要适用于肥胖或超重的2型糖尿病患者，其不良反应较少，为2型糖尿病患者的一线降糖药物，故二甲双胍为首选（D对）。阿卡波糖（A错）和瑞格列奈（B错）主要用于降低餐后高血糖，本例患者餐后和空腹血糖均较高。罗格列酮（C错）为胰岛素增敏剂，主要用于胰岛素抵抗的2型糖尿病。格列本脲（E错）主要用于非肥胖型糖尿病。